某男，69岁。因肛门有脱出物且大便带血到医院就诊。患者常年肛门松弛，时有痔核脱出，需手法还纳，便血色淡，面白，乏力，纳呆，舌淡，边有齿痕脉弱。宜选用的方剂是
A. 槐花散加减
B. 补中益气汤加减
C. 脏连丸加减
D. 止痛如神汤加减
E. 凉血地黄汤加减

正确答案：B。补中益气汤加减

解析：本题考查的是痔疮的辨证论治。因肛门有脱出物且大便带血到医院就诊。患者常年肛门松弛，时有痔核脱出，需手法还纳，便血色淡，面白，乏力，纳呆，舌淡，边有齿痕脉弱。宜选用的方剂是补中益气汤加减（B对）。痔是指直肠末端黏膜下和肛管皮肤下的静脉丛发生扩大、曲张所形成的柔软静脉团。临床以便血、脱出、肿痛为特点。根据其发病部位不同，临床可分为内痔、外痔和混合痔。其中，发生于齿状线以上的称为内痔，以便血、痔核脱出以及肛门不适感为临床特点；发生于齿状线之下的称为外痔，以自觉坠胀、疼痛和异物感为主要临床特点；混合痔位于齿状线上下同一点位，表面分别为直肠黏膜和肛管皮肤所覆盖，临床表现具有内痔、外痔的双重症状。西医学中痔疮表现为上述症状者，可参考此内容辨证论治。（一）风伤肠络证：【症状】大便带血，滴血或喷射状出血，血色鲜红，或有肛门瘙痒。舌质红，苔薄白或薄黄，脉浮数。【方剂应用】基础方剂为凉血地黄汤（细生地、当归尾、地榆、槐角、黄连、天花粉、升麻、赤芍、枳壳、黄芩、荆芥、生甘草、生侧柏）加减（E错）。（二）湿热下注证：【症状】内痔可见便血色鲜红，量较多，肛内肿物外脱，可自行回缩，肛门灼热。外痔可见肛缘肿物隆起，灼热疼痛，咳嗽、行走、坐位均可使疼痛加剧，便干或溏，溲赤。舌质红，苔黄腻，脉弦数。【方剂应用】基础方剂为脏连丸（黄连、黄芩、赤芍、当归、阿胶珠、荆芥穗、炒槐花、地榆炭、地黄、蜜炙槐角、猪大肠）加减（C错）。（三）气滞血瘀证：【症状】内痔常见肛内肿物脱出，甚至嵌顿，肛管紧缩，坠胀疼痛，甚则肛缘水肿、血栓形成，触痛明显。外痔可见肛缘肿物突起，排便时可增大，有异物感，可有胀痛或坠痛，局部可触及硬性结节。舌质暗红，苔白或黄，脉弦或涩。【方剂应用】基础方剂为止痛如神汤（秦艽、桃仁、皂角子、苍术、防风、黄柏、当归、泽泻、槟榔、熟大黄）加减（D错）。（四）脾虚气陷证：【症状】肛门松弛，痔核脱出须手法复位，便血色鲜或淡；伴面白少华，少气懒言，纳少便溏。舌质淡，边有齿痕，苔薄白，脉弱。【方剂应用】基础方剂为补中益气汤（黄芪、人参、炙甘草、当归、橘皮、升麻、柴胡、白术）加减。方剂应用为槐花散加减（A错）的病证，2022年考试指南未明确说明。